丹参的药用部位是
A. 根
B. 根茎
C. 块茎
D. 根及根茎
E. 鳞茎

正确答案：D。根及根茎

解析：本题考查的是丹参的来源。丹参的药用部位是根及根茎（D对）。丹参：【来源】为唇形科植物丹参的干燥根和根茎。入药部位为根（A错）的中药有牛膝、川牛膝、商陆、银柴胡、白芍、赤芍、板蓝根、地榆、苦参、葛根、粉葛、黄芪、西洋参、白芷、当归等。入药部位为根茎（B错）的中药有狗脊、黄连、升麻、北豆根、川芎、胡黄连、白术、苍术、香附、石菖蒲、黄精、玉竹、重楼、土茯苓、知母、射干、莪术、姜黄等。入药部位为块茎（C错）的中药有延胡索、三棱、泽泻、天南星、半夏、白及等。入药部位为鳞茎（E错）的中药有川贝母、浙贝母等。